治疗麻疹见形期，应首选
A. 宣毒发表汤
B. 清解透表汤
C. 透疹凉解汤
D. 解肌透痧汤
E. 凉营清气汤

正确答案：B。清解透表汤

解析：麻疹见形期即出疹期可见壮热持续，起伏如潮，肤有微汗，烦躁不安，目赤眵多，咳嗽阵作，皮疹布发，疹点由细小稀少而逐渐稠密，疹色先红后暗，皮疹凸起，触之碍手，压之退色，治宜清凉解毒，透疹达邪，方用清解透表汤加减（B对）。宣毒发表汤功能辛凉透表、清宣肺卫，用于麻疹之邪犯肺卫证（A错）。透疹凉解汤功能清气凉营解毒，用于风痧之邪入气营证（C错）。解肌透痧汤功能辛凉宣透、宣肺利咽，用于猩红热之邪侵肺卫（D错）。凉营清气汤功能清气凉营，泻火解毒，用于猩红热之毒炽气营证（E错）。